何种神经节是椎旁节
A. 睫状神经节
B. 腹腔神经节
C. 肠系膜神经节
D. 肠系膜上神经节
E. 交感干中的神经节

正确答案：E。交感干中的神经节

解析：椎旁神经节又称交感干神经节（E对）,交感干全长可分颈、胸、腰、骶、尾5部。椎前神经节包括腹腔神经节（B错）,肠系膜上神经节（D错）、肠系膜下神经节及主动脉肾神经节等。